注射乙肝疫苗后阳性的标志是
A. 抗2002U1-HBe
B. HBeAg
C. 抗2002U1-HBs
D. HBsAg
E. 抗2002U1-HBc

正确答案：C。抗2002U1-HBs

解析：接种乙肝疫苗可刺激免疫系统产生保护性抗体—抗2002U1-HBs，抗2002U1-HBs存在于人的体液中，能够清除乙型肝炎病毒，阻止乙型肝炎病毒感染，对乙型肝炎病毒感染及再感染具有保护作用，所以注射乙肝疫苗后阳性的标志是抗2002U1-HBs为阳性（C对）。抗2002U1-HBs阳性亦可见于HBV感染恢复。抗HBe（A错）在HBeAg消失后产生，提示HBV复制减弱或趋于停止。HBeAg（B错）为HBV感染后与HBsAg同时或稍后出现的血清学标志，是病毒复制的重要指标。HBsAg（D错）是HBV感染的血清学标志，HBV感染后早至1～2周，迟则11～12周可检出5急性自限性肝炎于6个月内消失，在无症状携带者或慢性乙型肝炎患者中HBsAg可持续存在多年，甚至终生。HBcAg存在于HBV颗粒的核心及感染的肝细胞核内，血液中不易检出，但其抗原性强，于感染后早期即可刺激机体产生抗2002U1-HBc（E错），抗2002U1-HBcIgM为急性感染及慢性感染病情活动的标志，抗2002U1-HBcIgG出现较迟，见于急性感染恢复期和慢性感染期。